生活饮用水水质标准的制定原则是
A. 流行病学安全
B. 所含化学物质对人无害
C. 感官性状良好
D. 经济技术上可行
E. 以上都是

正确答案：E。以上都是

解析：本题考查生活饮用水水质标准的制定原则。在研究制定生活饮用水水质标准时，要求水中不得含有病原体，保证水在流行病学上的安全性；水中所含化学物质和放射性物质对人体健康无害；水的感官性状良好。此外，在选择指标和确定标准限值时要考虑经济技术上的可行性（E对ABCD错）。